即可通过水平传播，也可通过垂直传播的疾病是
A. 麻疹
B. 流行性感冒
C. 流行性脑脊髄膜炎
D. 甲型肝炎
E. 乙型肝炎

正确答案：E。乙型肝炎

解析：呼吸道传播、消化道传播、接触传播、虫媒传播、血液和体液传播统称为水平传播，即血液、体液传播属于水平传播，母婴传播属于垂直传播，乙肝的具体传播途径主要有母婴传播和血液、体液传播，故既可通过水平传播，也可通过垂直传播的疾病是乙型肝炎（E对）。麻疹经呼吸道和接触传播，为水平传播而无垂直传播（A错）。流行性感冒经呼吸道和接触传播，为水平传播而无垂直传播（B错）。流行性脑脊髓膜炎的病原菌为脑膜炎奈瑟菌，传播途径主要为呼吸道传播，为水平传播而无垂直传播（C错）。甲型肝炎主要经粪-口途径传播，无垂直传播（D错）。